治疗心绞痛急性发作，应首选
A. 硝酸甘油
B. 普萘洛尔
C. 维拉帕米
D. 硝酸戊四醇酯
E. 硝酸异山梨醇酯

正确答案：A。硝酸甘油

解析：心绞痛的治疗分为发作时的治疗和缓解期的治疗。心绞痛急性发作，应使用作用较快的硝酸酯制剂，这类药物可扩张冠脉，增加冠脉循环的血流量，还可扩张周围血管，减少静脉回流心脏的血量，降低心脏前后负荷和心肌的需氧，从而缓解心绞痛。其首选药物为硝酸甘油（A对），也可选用硝酸异山梨醇酯（E错）。普萘洛尔（B错）和维拉帕米（C错）常用于心绞痛缓解期的治疗。硝酸戊四醇酯（D错）为长效硝酸甘油，主要用于预防心绞痛的发作。